违反《中华人民共和国广告法》规定，在药品广告发布中说明治愈率或有效率的，对广告者责令改正，没收广告费用，可并处罚款，实施处罚的机关是
A. 药品监督管理部门
B. 物价管理部门
C. 工商行政管理部门
D. 卫生行政管理部门
E. 公安部门

正确答案：C。工商行政管理部门

解析：本题考查广告管理。《中华人民共和国广告法》第十四条规定，药品、医疗器械广告不得有说明治愈率或者有效率的内容。第四十一条又规定，违反本法第十四条规定，广告监督管理机关责令负有责任的广告主、广告经营者、广告发布者改正或者停止发布，没收广告费用，可以并处以广告费用一倍以上五倍以下的罚款；情节严重的，依法停止其广告业务。县级以上人民政府工商行政管理部门（C对）是广告监督管理机关。